结构中含有嘧啶结构，常与磺胺甲噁唑组成复方制剂的药物是
A. 盐酸诺氟沙星
B. 磺胺嘧啶
C. 氧氟沙星
D. 司帕沙星
E. 甲氧苄啶

正确答案：E。甲氧苄啶

解析：本题考查甲氧苄啶的结构特征。甲氧苄啶（E对）与磺胺甲噁唑组成复方新诺明，产生协同抑菌效应。盐酸诺氟沙星（A错）、氧氟沙星（C错）、司帕沙星（D错）属于喹诺酮类抗菌药物，不具有嘧啶结构。磺胺嘧啶（B错）不与磺胺甲噁唑组成复方制剂。